引起代谢性酸中毒原因中例外的是
A. 心脏停跳
B. 剧烈呕吐
C. 缺氧
D. 长期饥饿
E. 休克

正确答案：B。剧烈呕吐

解析：剧烈呕吐使富含HCl的胃液大量丢失而引起代谢性碱中毒（B错，为本题正确答案）。休克（E对）、心脏停跳（A对）、缺氧（C对）使细胞内糖的无氧酵解增强而引起乳酸增加，产生乳酸性酸中毒，长期饥饿（D对）大量动用脂肪供能，可出现酮症酸中毒。